患者，男，68岁，哮喘病史18年1月前感冒后咳嗽一直未愈，现咳喘无力，动则尤甚，神疲，声低懒言，腰酸，耳鸣，咳则有尿液溢出舌淡胖，苔白滑，脉沉细，属于
A. 肺气虚
B. 肺脾气虚
C. 中气下陷
D. 寒饮阻肺
E. 肺肾气虚

正确答案：E。肺肾气虚

解析：肾为气之根，肺司呼吸，肾主纳气，肺气虚，呼吸功能减弱，则久病咳嗽；咳喘久延不愈，累及于肾，致肺肾气虚，则肾不纳气，气不归元，故咳喘无力，动则尤甚；宗气不足，则神疲，声低懒言；耳窍失充，则耳鸣；肾气不足，失其充养，则腰膝酸软；故可辨证为肺肾气虚证（E对）。肺气虚证，临床表现为咳嗽无力，气短而喘，动则尤甚，咯痰清稀，声低懒言，或有自汗、畏风，易于感冒，神疲体倦，面色淡白，舌淡苔白，脉弱（A错）。肺脾气虚证，临床表现为食欲不振，食少，腹胀，便溏，久咳不止，气短而喘，咯痰清稀，面部虚浮，下肢微肿，声低懒言，神疲乏力，面白无华，舌淡，苔白滑，脉弱（B错）。中气下陷证，临床表现为眩晕，久泄，脘腹重坠作胀，食后益甚，或小便混浊如米泔，或便意频数，肛门重坠，甚或内脏下垂，或脱肛、子宫下垂，神疲乏力，气短懒言，面白无华，纳少，舌淡苔白，脉缓或弱（C错）。寒饮阻肺证，临床表现为咳嗽气喘，痰多色白，或喉中哮鸣，胸闷，形寒肢冷，舌淡苔白腻或白滑，脉濡缓或滑（D错）。